既补气养血，又调经止带的药是
A. 益母草膏
B. 四物合剂
C. 逍遥合剂
D. 乌鸡白凤丸
E. 妇康宝口服液

正确答案：D。乌鸡白凤丸